女，45岁，间歇上腹隐痛，饱胀不适六年，查体无异常。胃镜检查胃窦粘膜苍白，变薄，可透见粘膜下紫蓝色的血管网。最可能诊断为
A. 慢性浅表性胃炎
B. 慢性萎缩性胃炎
C. 慢性肥厚性胃炎
D. 瘢痕期胃溃疡
E. 早期胃癌

正确答案：B。慢性萎缩性胃炎

解析：患者中年女性，间歇上腹隐痛，饱胀不适六年，查体无异常（有长期上腹不适病史，体征不明显，考虑慢性胃炎），胃镜检查胃窦粘膜苍白，变薄，可透见粘膜下紫蓝色的血管网（病变扩展至腺体深部，腺体破坏、黏膜变薄，为慢性萎缩性胃炎表现），综合病史、实验室检查最可能诊断为慢性萎缩性胃炎（B对）。慢性浅表性胃炎（A错）胃镜下主要表现为充血性红斑、水肿等；慢性肥厚性胃炎（C错）胃镜下可见腺体肥大增生，腺管延长，有时增生的腺体可穿过粘膜肌层；瘢痕期胃溃疡（D错）胃镜下可见瘢痕形成，周边无充血、水肿，可见再生上皮及粘膜集中象；早期胃癌（P376）（E错）表现为小的息肉隆起或凹陷，也可呈平坦样，粘膜粗糙，触之易出血，斑片状出血及糜烂。